发现营养缺乏病早期征象的营养评价方法是通过
A. 评价个人和群体膳食的质和量
B. 病史采集
C. 有关实验室检查
D. 对每人每日营养素摄入量的调查
E. 常规的体格检查

正确答案：A。评价个人和群体膳食的质和量

解析：本题考查发现营养缺乏病早期征象的营养评价方法。发现营养缺乏病早期征象的营养评价方法是通过有关实验室检查（C对）。评价个人和群体膳食的质和量（A错）、对每人每日营养素摄入量的调查（D错）均属于膳食调查分析，可对人群能量及营养素摄入量、供能营养素来源及能量分配、蛋白质来源、膳食组成做出综合评价。病史采集（B错）、常规的体格检查（E错）可发现营养缺乏或不足的临床症状和体征，但对营养缺乏病早期征象并不敏感。